具有抗利尿作用的药物是
A. 氢氯噻嗪
B. 呋塞米
C. 螺内酯
D. 甘露醇
E. 氨苯蝶啶

正确答案：A。氢氯噻嗪

解析：本题考查氢氯噻嗪的药理作用。具有抗利尿作用的药物是氢氯噻嗪（A对）。氢氯噻嗪的药理作用：1.利尿作用；2.抗利尿作用；3.降压作用。呋塞米（B错）的药理作用：1.利尿作用；2.扩血管作用。螺内酯（C错）是醛固酮的竞争性拮抗药，利尿作用弱，起效缓慢而持久。甘露醇（D错）的药理作用：1.脱水作用；2.利尿作用；3.增加肾血流量。氨苯蝶啶（E错）有排Na⁺、利尿、保K⁺的作用。氨苯蝶啶并非竞争性拮抗醛固酮，它对肾上腺切除的动物仍有留钾利尿作用。